散点分布大致呈直线，随X值增大Y值减小，可初步判断两变量为
A. 正相关关系
B. 负相关关系
C. 完全正相关
D. 完全负相关
E. 尚不能确定

正确答案：B。负相关关系